患有心脏病的孕妇在分娩期要注意
A. 第一产程要消除孕妇的紧张情绪
B. 尽量少用抗生素
C. 没有必要缩短第二产程的时间
D. 产妇在第三产程如出血过多者，要以最快的速度输液
E. 产妇在第二产程时，要加腹压，尽可能缩短第二产程

正确答案：A。第一产程要消除孕妇的紧张情绪